关于热原性质的说法，错误的是
A. 具有不耐热性
B. 具有滤过性
C. 具有水溶性
D. 具有不挥发性
E. 具有被氧化性

正确答案：A。具有不耐热性

解析：本题考查热原的性质。热原的性质：①水溶性（C对）；②不挥发性（D对）；③耐热性（A错，为本题正确答案）；④过滤性（B对）；⑤其他性质。热原能被强酸、强碱、强氧化剂如高锰酸钾、过氧化氢以及超声波破坏（E对）。热原在水溶液中带有电荷，也可被某些离子交换树脂所吸附。